男性，36岁，肛周反复疼痛，伴脓性分泌物半年，查体：截石位肛周皮肤5点，7点两处外口。挤压脓血性溢液出。首选的治疗
A. 硬化剂注射
B. 抗生素治疗
C. 温水坐浴
D. 挂线疗法
E. 手术切除

正确答案：E。手术切除

解析：该患者男性，36岁，出现肛周反复疼痛，伴脓性分泌物，查体：截石位肛周皮肤5点，7点两处外口。挤压脓血性溢液，结合患者的表现和体征，提示肛瘘，首选手术治疗（E对）。注射硬化剂的作用是使痔和痔块周围产生无菌性炎症反应，黏膜下组织纤维化，致使痔块萎缩（A错）。抗生素一般用于感染性疾病（B错）。热水坐浴可改善局部血液循环（C错）。挂线疗法:利用橡皮筋或有腐蚀作用的药线的机械性压迫作用，缓慢切开肛瘘的方法。适用于距肛门3～5cm,有内外口的低位或高位单纯性肛瘘，或作为复杂性肛瘘切开、切除的辅助治疗。挂线疗法的最大优点是不会造成严重肛门失禁（D错）。